分泌褪黑素的是
A. 下丘脑
B. 腺垂体
C. 甲状腺
D. 肾上腺
E. 松果体

正确答案：E。松果体